关于粘膜下肌瘤的临床表现下列哪项是错误的
A. 不规则阴道出血
B. 发生症状较早较重
C. 易发生蒂扭转
D. 白带增多
E. 子宫呈均匀增大

正确答案：C。易发生蒂扭转

解析：易发生蒂扭转的是浆膜下肌瘤不是粘膜下肌瘤，因为粘膜下肌瘤是向子宫腔内生长的。黏膜下肌瘤是在子宫腔内生长的，故从子宫表面看来，子宫是均匀性增大的。掌握“子宫肌瘤”知识点。